向T细胞提供第二活化信号的重要共刺激分子是
A. CD28/B7
B. CD40/CTLA-4
C. CD4/MHCⅡ类分子
D. CD8/MHCⅠ类分子
E. LFA-1/ICAM-1

正确答案：A。CD28/B7